定群研究又称为
A. 队列研究
B. 现况调查
C. 病例对照研究
D. 临床随访研究
E. 试验研究

正确答案：A。队列研究

解析：队列研究（A对）是一种根据有无暴露某因素史分组的研究方法。现况调查（B错）（P047）是普查或抽样调查的方法收集一定的数据，并对数据分布特征加以描述的研究方式。病例对照研究（C错）（P059）则是根据是否患有某种待研究的疾病来分组的。临床随访研究（D错）即临床病例随访，通过收集临床患者的数据资料来评价各种临床干预措施对患者的疗效。试验研究（E错）是在医院或者其他医疗照顾环境下进行的试验研究。